6个月婴儿，呕吐，腹泻3天，大便10余次/日，呈蛋花汤样，有腥臭味，尿量极少，皮肤弹性差，前囟、眼窝明显凹陷，四肢厥冷。大便镜检白细胞偶见。血清钠135mmol/L。脱水的程度和性质
A. 中度等渗性脱水
B. 中度低渗性脱水
C. 重度等渗性脱水
D. 重度低渗性脱水
E. 重度高渗性脱水

正确答案：C。重度等渗性脱水

解析：根据该患儿皮肤弹性差，前囟眼窝明显凹陷，四肢厥冷，血清钠135mmol/L，可判定为等渗性重度脱水（C对）。